公卫医师何某在已取得执业医师资格证书和执业许可证后的1年里，擅自从事婚前医学检査，遗传病诊断和产前诊断，虽经卫生行政部门制止，仍不改正，并实施终止妊娠手术，据《母婴保健法》的规定，可以给予何种行政处罚
A. 处以罚款
B. 没收违法所得
C. 没收非法财物
D. 吊销执业许可证
E. 行政拘留

正确答案：A。处以罚款

解析：《母婴保健法》规定，未取得国家颁发的有关合格证书，有下列行为之一的，县级以上地方人民政府卫生行政部门应当予以制止，并可根据情节给予警告或者处以罚款（A对）：①从事婚前医学检查、遗传病诊断或者医学技术鉴定的；②施行终止妊娠手术的；③出具法律规定的有关医学证明的。公卫医师何某未取得国家颁发的有关合格证书，擅自从事婚前医学检査，遗传病诊断和产前诊断，虽经卫生行政部门制止，仍不改正，并实施终止妊娠手术，情节严重，根据《母婴保健法》规定，应处以罚款。